某女，38岁。症见郁闷不舒、胸胁胀痛、头晕目眩、食欲减退、月经不调。证属肝郁脾虚，宜选用的中成药是
A. 逍遥颗粒
B. 七制香附丸
C. 小柴胡颗粒
D. 木香顺气丸
E. 八珍益母丸

正确答案：A。逍遥颗粒

解析：本题考查逍遥颗粒的主治。证属肝郁脾虚，宜选用的中成药是逍遥颗粒（A对）。逍遥颗粒（丸）【主治】肝郁脾虚所致的郁闷不舒、胸胁胀痛、头晕目眩、食欲减退、月经不调。七制香附丸（B错）【主治】气滞血虚所致的痛经、月经量少、闭经，症见胸胁胀痛、经行量少、行经小腹胀痛、经前双乳胀痛、经水数月不行。小柴胡颗粒（C错）（片）【主治】外感病邪犯少阳证，症见寒热往来、胸胁苦满、食欲不振、心烦喜呕、口苦咽干。木香顺气丸（D错）（颗粒）【主治】湿阻中焦、脾胃不和所致的湿滞脾胃证，症见胸膈痞闷、脘腹胀痛、呕吐恶心、嗳气纳呆。八珍益母丸（E错）（胶囊）【主治】气血两虚兼有血瘀所致的月经不调，症见月经周期错后、行经量少、淋漓不净、精神不振、肢体乏力。